在病因推断过程中，反映某个因素与疾病的关联强度常用下列哪个指标
A. AR
B. RR
C. 归因危险度
D. 人群归因危险度
E. 人群归因危险度百分比

正确答案：B。RR

解析：本题考查相对危险度的意义。相对危险度（B对ACDE错）与归因危险度都是表示关联强度的重要指标，彼此密切相关，但其流行病学意义却不同。相对危险度说明暴露者发生相应疾病的危险是非暴露者的多少倍；归因危险度则是指暴露人群与非暴露人群比较，所增加的疾病发生数量，如果暴露因素消除，就可减少这个数量的疾病发生。相对危险度具有病因学的意义，归因危险度更具有疾病预防和公共卫生学上的意义。